局部麻醉术后麻木症状仍未恢复的可能原因是
A. 注射区有血肿
B. 注射区有感染
C. 注射区有神经损伤
D. 注射针折断
E. 注射区有水肿

正确答案：C。注射区有神经损伤

解析：本题考查局部麻醉术后麻木症状仍未恢复的原因。局部麻醉术后麻木症状仍未恢复，一般是注射区有神经损伤（C对）造成的，多是暂时的、可逆的，但严重者可能不能完全恢复。注射区有血肿（A错）表现为黏膜下或皮下出现紫红色瘀斑或肿块，无神经症状。注射区有感染（B错）表现为注射后1～5天局部红、肿、热、痛明显，甚至有张口受限或吞咽障碍，无神经症状。注射针折断（D错）表现为检查见常位于针头连接处折断，断针留于组织中，但只要不刺入神经，不会出现神经症状。注射区有水肿（E错）可能是过敏反应的表征，表现为注射区的肿胀，无神经症状。